截石位进行肛门检查属内痔好发部位
A. 3点钟
B. 5点钟
C. 9点钟
D. 6点钟
E. 12点钟

正确答案：A。3点钟

解析：截石位进行肛门检查属内痔好发部位是3（A对BCDE错）、7、11钟点位。